急性肺损伤致呼吸衰竭的主要机制是
A. 通透性肺水肿
B. 肺不张
C. 肺泡通气血流比例失调
D. 死腔样通气
E. J感受器刺激呼吸窘迫

正确答案：C。肺泡通气血流比例失调

解析：急性肺损伤致呼吸衰竭的主要机制是肺泡通气血流比例失调（C对）。